股骨颈与关节囊的关系
A. 后外l/3在囊外
B. 完全包在关节囊内
C. 完全在关节囊外
D. 前外1/3在囊外
E. 外侧1/3在囊外

正确答案：A。后外l/3在囊外

解析：髋关节的关节囊向上附着于髋臼周缘及横韧带，向下附着于股骨颈，前面达转子间线。后面包裹股骨颈的内侧 2/3，即股骨颈后外1/3在关节囊外（A对）。